6个月以下婴儿脂肪所提供的能量应占膳食总能量的比例为
A. 45%～50%
B. 30%～40%
C. 20%～40%
D. 25%～30%
E. 10%～20%

正确答案：A。45%～50%

解析：脂肪供能占总能量的比例：6个月以下婴儿为45%～50%，6个月～2岁为35%～40%，2～7岁为30%～35%，7岁以上为25%～30%。掌握“儿童营养基础”知识点。